对宗气的功能表达正确的是
A. 推动、调节各脏腑的生理活动
B. 营养全身
C. 调节作用
D. 温养作用
E. 与人的视、听、言、动等功能相关

正确答案：E。与人的视、听、言、动等功能相关

解析：宗气上走息道，推动肺的呼吸，因此，凡是呼吸、语言、发声皆与宗气有关；宗气贯注于心脉之中，促进心脏推动血液运行，因此，凡是血液的运行、心搏的力量及节律等皆与宗气有关。总之，宗气的功能与人的视、听、言、动等功能相关（E对）。元气具有推动和调控各脏的生理活动的功能（A错）。营养全身（B错）是营气的功能。卫气具有防御外邪，温养全身（D错）的作用的生理功能。